青蒿鳖甲汤主治证的热型是
A. 骨蒸潮热
B. 夜热早凉
C. 日晡潮热
D. 身热夜甚
E. 皮肤蒸热

正确答案：B。夜热早凉

解析：六味地黄丸是肝肾阴虚证引起的骨蒸潮热最常用的方剂（A错）。青蒿鳖甲汤主治温病后期，邪伏阴分证，其典型症状为夜热早凉，热退无汗（B对）。日晡潮热即阳明潮热，多见于阳明腑实证，方用承气汤类，如大承气汤（C错）。身热夜甚是热入营分证的典型症状，方用清营汤（D错）。泻白散主治肺热喘咳证，其热型为皮肤蒸热，日晡尤甚（E错）。